关于婴幼儿期用药特点的叙述正确的有
A. 口服给药时以糖浆剂为宜
B. 肌内注射给药不影响吸收
C. 使用吗啡易引起呼吸抑制
D. 使用氨茶碱无兴奋神经系统作用
E. 应用中枢镇静药时年龄愈小耐受力愈大

正确答案：A、C、E。口服给药时以糖浆剂为宜；使用吗啡易引起呼吸抑制；应用中枢镇静药时年龄愈小耐受力愈大

解析：本题考查新生儿用药。口服给药是最方便、最安全、最经济的给药途径，但影响因素较多，剂量不如注射给药准确，特别是吞咽能力差的婴幼儿受到一定限制。幼儿用糖浆、水剂、冲剂等较合适（A对），年长儿可用片剂或丸剂，服药时要注意避免牛奶、果汁等食物的影响；小婴儿喂药时最好将其抱起或使头略抬高，以免呛咳时将药吐出。病情需要时可采用鼻饲给药。新生儿血脑屏障发育不全，通透性高，很多药物易通过血脑屏障，使中枢神经系统易受药物影响。如吗啡较易使新生儿呼吸中枢受抑制（C对）；抗组胺药、氨茶碱、阿托品可致昏迷或惊厥（D错）。应用中枢镇静药时年龄愈小耐受力愈大（E对）。肌内注射时药物的吸收与局部血流量有关（B错），要充分考虑注射部位的吸收状况，避免局部结块、坏死，如使用含苯甲醇为添加剂的溶媒会导致臀肌挛缩症的严重不良反应；临床上肌内注射部位多选择在臀大肌外上方，但注射次数过多可能造成臀部肌肉损害，需加以注意，且不得用于儿童。